国家加强A型肉毒毒素的监督管理，将其列入的管理类别是
A. 医疗用毒性药品
B. 含麻黄碱类复方制剂
C. 国家免疫规划疫苗
D. 含兴奋剂药品

正确答案：A。医疗用毒性药品

解析：本题考查医疗毒性药品的品种与分类。国家加强A型肉毒毒素的监督管理，将其列入的管理类别是毒性药品（A对）。医疗用毒性药品：毒性药品的管理品种，由国务院卫生主管部门会同国务院药品监督管理部门规定。毒性药品的品种目录应以国家有关部门确定并公布的品种目录为准，现已公布的毒性药品的管理品种分为中药品种和西药品种两大类。1.毒性药品中药品种共27种：砒石（红砒、白砒）、砒霜、水银、生马钱子、生川乌、生草乌、生白附子、生附子、生半夏、生南星、生巴豆、斑蝥、青娘虫、红娘子、生甘遂、生狼毒、生藤黄、生千金子、生天仙子、闹羊花、雪上一枝蒿、白降丹、蟾酥、洋金花、红粉、轻粉、雄黄。需要说明的是上述中药品种是指原药材和饮片，不含制剂。2.毒性药品西药品种共13种：去乙酰毛花苷丙、阿托品、洋地黄毒苷、氢溴酸后马托品、三氧化二砷、毛果芸香碱、升汞、水杨酸毒扁豆碱、氢溴酸东莨菪碱、亚砷酸钾、士的宁、亚砷酸注射液、A型肉毒毒素及其制剂。需要说明的有两点，一是上述西药品种除亚砷酸注射液、A型肉毒毒素制剂以外的毒性西药品种是指原料药；二是上述西药品种士的宁、阿托品、毛果芸香碱等包括其盐类化合物。含麻黄碱类复方制剂（B错）属于含特殊药品复方制剂。国家免疫规划疫苗（C错）：免疫规划疫苗，是指居民应当按照政府的规定接种的疫苗，包括国家免疫规划确定的疫苗，省、自治区、直辖市人民政府在执行国家免疫规划时增加的疫苗，以及县级以上人民政府或者其卫生健康主管部门组织的应急接种或者群体性预防接种所使用的疫苗。兴奋剂（D错）分为七大类，包括：刺激剂、麻醉止痛剂、蛋白同化制剂、肽类激素及类似物、利尿剂、β受体阻滞剂、血液兴奋剂等。